男性，30岁。头痛，时有呕吐，逐渐加重1个月，近期嗜睡，反应迟钝，时有头晕猝倒，无头部外伤及急性炎症病史，血压正常。检查见视神经乳头水肿，血常规血沉正常。初步的临床诊断应考虑为
A. 颅脑损伤
B. 颅内肿瘤
C. 颅内感染
D. 急性脑疝
E. 椎动脉型颈椎病

正确答案：B。颅内肿瘤

解析：青年男性患者，头痛、呕吐、视神经乳头水肿（颅内压增高的表现），嗜睡、反应迟钝、时有头晕猝倒（神经功能定位症状），无头部外伤及急性炎症病史（可排除颅脑损伤、颅内感染），结合患者病史和临床表现，应考虑为颅内肿瘤（B对）。该患者无头部外伤史，因而暂不考虑颅脑损伤（A错）。该患者缺乏急性炎症临床症状，且血常规、血沉正常，暂不考虑颅内感染（C错）。急性脑疝（D错）进展迅速，头痛、呕吐等颅内压增高症状明显，常伴有不同程度的意识障碍和瞳孔改变。椎动脉型颈椎病（P727）（E错）可出现偏头痛、突发性眩晕、猝倒等表现，但不会出现呕吐、视神经乳头水肿等颅内压增高症状。